以下无牙颌印模范围的要求，哪项不正确
A. 包括整个牙槽嵴
B. 边缘伸展到唇颊舌沟
C. 上颌后缘伸展到腭小凹处
D. 上颌后缘伸展与后颤动线一致
E. 上颌两侧后缘伸展到翼上颌切迹

正确答案：C。上颌后缘伸展到腭小凹处

解析：腭小凹：腭小凹为位于软硬腭结合处稍后方中线的两侧，左右各一个的黏膜表面陷窝，内有黏液腺导管的开口。上颌全口义齿的后缘应在腭小凹后2mm处。掌握“无牙颌的印模与模型”知识点。